石决明具有的功效是
A. 补阳
B. 通阳
C. 升阳
D. 潜阳
E. 回阳

正确答案：D。潜阳

解析：该题考查石决明的功效。石决明味咸，性寒，归肝经，其功效为平肝潜阳，清肝明目（D对）。